患者女性，26岁，停经45天，突感下腹坠痛及肛门坠胀感，少量阴道流血及头晕呕吐半天。体格检查：面色苍白，BP80/40mmHg，腹肌略紧张，下腹压痛。妇科检査：阴道少量血性物，宫颈举痛（+）穹窿饱满，子宫稍大，附件区触诊不满意。本例最可能的诊断是
A. 先兆流产
B. 卵巢囊肿蒂扭转
C. 黄体破裂
D. 急性盆腔炎
E. 异位妊娠

正确答案：E。异位妊娠

解析：本题考查异位妊娠。据患者的症状及临床检查，最可能的诊断为异位妊娠（E对）。